连翘的原植物属于
A. 鼠李科
B. 木犀科
C. 旋花科
D. 茄科
E. 茜草科

正确答案：B。木犀科

解析：本题考查的是连翘的来源。果连翘的原植物属于木犀科（B对）。连翘：【来源】为木犀科植物连翘的干燥果实。来源于鼠李科（A错）的中药有酸枣仁。来源于旋花科（C错）的中药有菟丝子、牵牛子。来源于茄科（D错）的中药有地骨皮、洋金花、枸杞子、天仙子等。来源于茜草科（E错）的中药有巴戟天、茜草、钩藤、栀子、白花蛇舌草等。